原尿的成分
A. 和终尿近似
B. 比终尿多葡萄糖
C. 比终尿多Na⁺、K⁺
D. 比血浆少葡萄糖
E. 比血浆少蛋白质

正确答案：E。比血浆少蛋白质